这是某中学初中三年级的每周课表：星期四第二、三节都是物理课，违背了大脑皮层功能活动的
A. 始动调节
B. 优势法则
C. 动力定型
D. 镶嵌式活动
E. 保护性抑制

正确答案：D。镶嵌式活动